口腔颌面外科手术全麻后易造成呼吸困难的原因是
A. 拔管或术中气管内插管的移动造成的喉头损伤
B. 手术留置插管的时间过长
C. 咽后壁、舌根等部位手术造成组织移位
D. 口腔内异物、渗血或分泌物阻塞
E. 以上均是原因

正确答案：E。以上均是原因

解析：本题考查口腔颌面外科手术全麻后易造成呼吸困难的原因。影响气道通畅造成呼吸困难的原因很多，但与口腔颌面外科手术全麻有关的原因如下：手术、全麻、损伤等综合原因，能促使血液、各种口腔内异物、渗血或分泌物（D对）在口、咽腔或呼吸道聚积，导致呼吸困难、窒息等；拔管或术中气管内插管的移动造成的喉头损伤（A对），引起上呼吸道充血肿胀，进而出现呼吸困难；手术留置插管的时间过长（B对）可能导致咽喉部肿胀疼痛，造成呼吸道狭窄；咽后壁、舌根等部位手术造成组织移位（C对），如舌根后坠，则不能保持呼吸道通畅，造成呼吸困难。（ABCD均对，故E为本题的正确答案）。